泄露患者隐私造成严重后果
A. 追究刑事责任
B. 吊销医师执业证书
C. 罚款
D. 承担赔偿责任
E. 警告或责令暂停执业活动6月～1年

正确答案：E。警告或责令暂停执业活动6月～1年

解析：《执业医师法》规定，医师在执业活动中，泄露患者隐私造成严重后果的，由卫生行政部门给予警告或责令暂停执业活动6个月～1年（E对）；情节严重的，吊销其执业证书（B错）；构成犯罪的，依法追究刑事责任（A错）。题干未说明是否情节严重或构成犯罪，因而不构成吊销医师执业证书（B错）或追究刑事责任（A错）的处罚。